神经纤维动作电位的幅度接近于
A. 钾平衡电位
B. 钠平衡电位
C. 静息电位绝对值与局部电位之和
D. 静息电位绝对值与钠平衡电位之差
E. 静息电位绝对值与钠平衡电位之和

正确答案：E。静息电位绝对值与钠平衡电位之和